男，咳嗽，咳脓痰，反复咯血多年，并伴有乏力，发热，消瘦。可能的诊断是
A. 慢性支气管炎
B. 肺结核
C. 支气管扩张
D. 肺脓肿
E. 肺囊肿

正确答案：C。支气管扩张

解析：患者男性，有长期咳嗽、咳脓痰和咯血（支气管扩张常见的临床表现）病史，并有乏力，发热（提示感染加重），消瘦等症状，因此可能的诊断是支气管扩张（C对）。慢性支气管炎（P20）（A错）主要症状为咳嗽、咳痰，或伴有喘息，一般为白色黏液和浆液泡沫性痰，偶可带血。肺结核（P65）（B错）多表现为长期午后潮热，夜间盗汗，痰的性质多为黏液性痰，倦怠乏力和食欲减退等症状。肺脓肿（P58）（D错）临床特征为高热，咳嗽和咳大量脓臭痰，症状一般不会持续多年。肺囊肿（P60）（E错）继发感染可出现咳嗽、咳痰表现，但一般不会出现脓性痰。